44.5℃时能生长繁殖发酵乳糖而产酸、产气的菌群
A. 细菌总数
B. 总大肠菌群
C. 粪大肠菌群
D. 粪链球菌群
E. 肠球菌总数

正确答案：C。粪大肠菌群

解析：本题考查粪大肠菌群。粪大肠菌群（C对ABDE错）是一群在44.5℃培养24小时，能使乳糖发酵产酸产气的细菌。它来源于人和温血动物粪便，是判断饮用水是否受粪便污染的重要微生物指标。